被誉为“疮家圣药”的药物是
A. 连翘
B. 白头翁
C. 土茯苓
D. 蒲公英
E. 板蓝根

正确答案：A。连翘

解析：本题考查连翘的功效主治，对于有“要药”、“圣药”、“良药”之称额药物都需牢固掌握。